口腔扁平苔藓（OLP）上皮固有层内有大量淋巴细胞呈密集带状浸润与下列哪项因素有关
A. 心理因素
B. 内分泌因素
C. 微循环障碍因素
D. 免疫因素
E. 遗传

正确答案：D。免疫因素

解析：免疫因素病理检查可见口腔扁平苔藓（OLP）上皮固有层内有大量淋巴细胞呈密集带状浸润是其典型病理表现之一，因而考虑OLP与免疫因素有关。掌握“口腔扁平苔藓”知识点。